关于干扰素的特性，哪项是错误的
A. 具有抗肿瘤、免疫调节作用
B. 具有种属特异性
C. 具有直接杀灭病毒作用
D. 具有广谱抗病毒作用
E. 属于非特异性免疫因素

正确答案：C。具有直接杀灭病毒作用

解析：干扰素（IFN）是病毒或其他干扰素诱生剂刺激人或动物细胞所产生的一种糖蛋白，具有抗病毒、抗肿瘤和免疫调节等多种生物学活性。干扰素的抗病毒作用具有相对的种属特异性，干扰素具有广谱抗病毒作用，但只能抑制病毒而无杀灭病毒的作用。掌握“病毒传播方式、感染类型、致病机制及免疫”知识点。